标定盐酸溶液（0.1mol/L）的基准物质是
A. NaCl
B. 无水碳酸钠
C. KI
D. 溴酸钾
E. 重铬酸钾

正确答案：B。无水碳酸钠

解析：本题考查盐酸溶液的标定。标定盐酸溶液的常用基准物质为无水碳酸钠（B对）。